口腔黏膜的痛觉分布不均匀，以下各项中痛觉最为敏锐的部位是
A. 硬腭
B. 舌尖
C. 口唇
D. 牙龈缘处
E. 都不敏感

正确答案：D。牙龈缘处

解析：口腔黏膜的痛觉分布不均匀，与第二磨牙相对的颊黏膜区有触觉感受点而无痛觉感受点，自颊侧黏膜中央至口角的一段带状区痛觉较迟钝，称为无痛区，而牙龈、硬腭、舌尖、口唇等处有明显的痛点分布，其中牙龈缘处痛觉最为敏锐。口腔黏膜自前牙区向磨牙区的痛点依次减少。掌握“口腔感觉”知识点。